关于风疹描述错误的是
A. 通过空气飞沫传播
B. 人类是风疹病毒的唯一自然宿主
C. 在出疹前、中、后数天内传染性最强
D. 风疹病毒耐热，在38℃室温能存活4小时
E. 除鼻咽分泌物外，血、尿、粪中也可有病毒存在

正确答案：D。风疹病毒耐热，在38℃室温能存活4小时

解析：风疹病毒只有一种抗原型，不耐热，在室温中很快失去活力，但能耐寒和干燥（D错，为本题正确答案）。病人是唯一的传染源，主要经呼吸道飞沫传播（A对），多见于5岁以下小儿，在幼托场所可发生流行（B对）。出疹前7天及疹后5天，在患儿鼻咽部的分泌物中能找到病毒，故在出疹前、中、后数天内传染性最强（C对）。病毒血症发生较早，在疹前7天即已存在，同时胎儿感染风疹病毒后，病毒可在新生儿咽部持续存在，并由大小便排出，长达6个月或更久，故除鼻咽分泌物外，血、尿、粪中也可有病毒存在（E对）。